药师应掌握处方中常用的外文缩写，“必要时”用药的缩写是
A. qid
B. qn.
C. prn
D. qd.
E. q4h

正确答案：C。prn

解析：本题考查处方中常见的外文缩写及其含义。prn（C对）为“必要时”用药的缩写。“每日4次”用药的缩写是qid.（A错）“每晚”用药的缩写是qn.（B错）“每日”用药的缩写是qd.（D错）“每4小时”用药的缩写是q4h（E错）。